第二类精神药品一般每张处方不得超过几日常用量
A. 1天
B. 3天
C. 7天
D. 10天
E. 15天

正确答案：C。7天

解析：第二类精神药品一般每张处方不得超过7日常用量；对于慢性病或某些特殊情况的患者，处方用量可以适当延长，医师应当注明理由。掌握“处方的开具、监督管理及法律责任”知识点。